梅毒的病原体是
A. 沙眼衣原体
B. 疱疹病毒
C. 人免疫缺陷病毒
D. 苍白密螺旋体
E. HPV

正确答案：D。苍白密螺旋体

解析：梅毒的病原体是苍白密螺旋体（D对）。沙眼衣原体（A错）根据感染机体部位不同，可引起不同类型的疾病，如傻眼、新生儿眼炎、包涵体结膜炎、尿道炎等（P193表20-3）。疱疹病毒（B错）根据分型可导致不同的疾病，如人疱疹病毒1型引起口咽炎，唇、眼、脑部感染，人疱疹病毒2型导致生殖器疱疹等（P294表31-1）。人免疫缺陷病毒（HIV）（C错）是获得性免疫缺陷综合征（AIDS）即艾滋病的病原体（P305）。人乳头瘤病毒（HPV）（E错）主要引起人类皮肤黏膜的增生性病变，低危性HPV（6型、11型等）引起生殖器尖锐湿疣，高危型HPV（16型、18型等）与子宫颈癌等恶性肿瘤的发生密切相关（P316）。